劳动时直接供给机体能量的物质的是
A. 三磷酸腺苷（ATP）
B. 二磷酸腺苷（ADP）
C. 磷酸肌酸（CP）
D. 肌酸
E. 糖原

正确答案：A。三磷酸腺苷（ATP）